副交感神经节不出现
A. 翼腭神经节
B. 睫状神经节
C. 下颌下神经节
D. 三叉神经节
E. 耳神经节

正确答案：D。三叉神经节

解析：位于颅部的副交感神经节较大，肉眼可见，有睫状神经节（B对）、下颌下神经节（C对）、翼腭神经节（A对）和耳神经节（E对）等。三叉神经节（D错，为本题正确选项）三叉神经节由假单极神经元胞体组成，不含副交感神经节。